26岁男患者，家住沈阳。于12月突然发病，表现为发冷、寒战、高热、大汗后而缓解，隔日发作一次，已10天。体检：脾肋下1cm，余未见异常，末梢血化验：WBC5.0×10⁹/L，N0.68，L0.32，Hb100g/L，血培养（-）。患者同年8月曾去海南旅游半个月。该患者发热最可能的原因是
A. 伤寒
B. 疟疾
C. 败血症
D. 急性血吸虫病
E. 急性粒细胞型白血病

正确答案：B。疟疾

解析：本例患者，8月有海南旅游史，发冷寒战高热大汗而后缓解，隔日发作，脾大，血红蛋白Hb100g/L（成年男性血红蛋白正常参考值120～160g/L），应诊断为间日疟（B对）。伤寒（A错）、败血症（C错）、急性血吸虫病（D错）、急性粒细胞型白血病（E错）都没有隔日发作这种临床表现。